可延长局麻药的局麻作用时间的药物是
A. 去甲肾上腺素
B. 肾上腺素
C. 异丙肾上腺素
D. 甲状腺素
E. 多巴胺

正确答案：B。肾上腺素

解析：肾上腺素加入局麻药注射液中可延缓局麻药的吸收，减少中毒的可能性，同时延长局麻药的麻醉时间（B对）。